液体制剂中，苯甲酸属于
A. 增溶剂
B. 防腐剂
C. 矫味剂
D. 着色剂
E. 潜溶剂

正确答案：B。防腐剂

解析：本题考查液体制剂常用的附加剂。液体制剂中苯甲酸属于防腐剂（B对）；增溶剂（A错）为具增溶能力的表面活性剂；矫味剂（C错）指药品中用以改善或屏蔽药物不良气味和味道的药用辅料；着色剂（D错）是为药品着色的物质；潜溶剂（E错）指能形成氢键以增加难溶性药物溶解度的混合溶剂。